下列对女性尿道的描述，何者错误
A. 较男尿道宽、短、直
B. 通过尿生殖膈
C. 尿道外口位于阴道口的前方
D. 尿道内口较男性位置低
E. 开口于阴道与肛门之间

正确答案：E。开口于阴道与肛门之间

解析：女性尿道外口位于阴道口的前方（C对,E错为本题正确答案），故阴道开口于尿道与肛门之间。女性尿道较男尿道宽、短、直（A对），穿过尿生殖膈（B对），尿道内口较男性位置低（D对），